高致病性病原微生物菌（毒）种或者样本的包装材料
A. 应当密封
B. 主管与人体健康有关的实验室及其实验活动的生物安全监督工作
C. 主管与人体健康有关的实验室及其实验活动的生物安全管理工作
D. 应当印有生物危险标识和警告用语
E. 应应当经国务院卫生主管部门批准

正确答案：D。应当印有生物危险标识和警告用语